男，35岁。弯腰活动后出现腰部臀部疼痛，腰部活动受限，左小腿麻木。经卧床休息半个月症状略有缓解。查体：腰部压痛，左外踝及足外侧痛觉减退，左侧踝反射减弱，左下肢直腿抬高试验（土）。最可能的诊断是
A. 腰肌劳损
B. 腰椎间盘突出症
C. 腰椎管狭窄症
D. 梨状肌综合征
E. 腰椎结核

正确答案：B。腰椎间盘突出症

解析：患者青年男性，弯腰活动后出现腰部臀部疼痛（前屈位腰部活动受限），左小腿麻木（神经受累表现），卧床休息后症状略有缓解。腰部压痛。左外踝及足外侧痛觉减退，左侧踝反射减弱（骶1神经根受累表现）。综合患者病史、临床表现及体征，可考虑诊断为腰椎间盘突出（B对）。腰肌劳损（A错）直腿抬高试验阴性，下肢无神经受累表现。腰椎管狭窄症（C错）临床上以下腰痛、马尾神经或腰神经受压症状为主要表现，以神经源性间歇性跛行为主。梨状肌综合征（D错）查体可见臀肌萎缩，臀部深压痛及直腿抬高试验阳性，但神经定位体征多不明确。腰椎结核（E错）有结核病史或接触史。常有午后低热、乏力等全身中毒症状，血沉快。